女性，28岁。右下6近中邻面浅龋，舌尖缺损，牙冠短小。拟3/4冠修复。除轴沟外，增加固位作用，阻挡舌向脱位的有效措施是
A. 轴壁龈端肩台
B. 舌侧制成两个斜面
C. （牙合）面沟
D. 轴壁倒凹
E. 减小邻面聚合度

正确答案：C。（牙合）面沟

解析：后牙3/4冠抵抗舌向脱位的固位型包括轴沟和（牙合）面沟。A、B、E选项均无抵抗舌向脱位的作用，而轴壁形成倒凹时，3/4冠将无法就位。掌握“部分冠”知识点。